与强利尿药配伍使用，会造成听神经和肾功能的不可逆损害的药物是
A. 氨基糖苷类
B. β-内酰胺类
C. 大环内酯类
D. 四环素类
E. 氟喹诺酮类

正确答案：A。氨基糖苷类

解析：本题考查药物的联合应用。氨基糖苷类（A对）本身有耳毒性和肾毒性，强利尿剂也有肾毒性和耳毒性，两者合用，毒性增强。β-内酰胺类（B错）不良反应常见皮疹、荨麻疹、过敏性休克等。大环内酯类（C错）不良反应为呕吐、腹胀、腹泻等。四环素类（D错）不良反应为肠道菌群失调。氟喹诺酮类（E错）可致肌痛、骨关节病损、跟腱炎症等。